下列哪项是左室衰竭的重要体征
A. 奇脉
B. 交替脉
C. 脉搏强大
D. 脉搏过缓
E. 脉搏绝对不齐

正确答案：B。交替脉

解析：左室衰竭以肺循环淤血及心排血量降低为主要表现，其重要体征包括交替脉（B对）（一种节律正常而强弱交替的脉搏）、舒张早期奔马律等。奇脉（A错）是指吸气时脉搏明显减弱或消失，系左心室搏血量减少所致，主要见于心包压塞或心包缩窄。脉搏强大（C错）主要见于高热、甲状腺功能亢进、主动脉关闭不全等。脉搏过缓（D错）主要见于颅内高压、Ⅱ度或以上房室传导阻滞等。脉搏绝对不齐（E错）主要见于心房颤动。